20岁未婚女性，初潮14岁，近3年月经周期规律。一年前经量逐渐减少，半年前闭经，基础体温呈双相型曲线。本例最可能的疾病是
A. 子宫颈管狭窄
B. 子宫发育不良
C. 子宫内膜结核
D. 卵巢睾丸母细胞瘤
E. 垂体功能低下

正确答案：C。子宫内膜结核

解析：患者为年轻女性（子宫内膜结核，多见于20～40岁妇女），出现经量稀少至闭经（晚期因子宫内膜遭不同程度破坏而表现为月经稀少或闭经，多数患者就诊时已为晚期），基础体温呈双相型曲线（排卵正常，则卵巢、垂体、下丘脑正常，病变部位在子宫），最可能的疾病是子宫内膜结核（C对），排除卵巢睾丸母细胞瘤（D错）、垂体功能低下（E错）。子宫颈管狭窄（A错）、子宫发育不良（P277）（B错）不会出现月经规律，后经量稀少至闭经。